特殊人群高血压的治疗，脑血管病病人宜选用的药物是
A. α-受体阻断剂（α-RB）
B. β-受体阻断剂（β-RB）
C. 噻嗪类利尿药
D. 醛固酮受体拮抗剂
E. 血管紧张素转换酶抑制剂（ACEI）

正确答案：C。噻嗪类利尿药

解析：本题考查抗高血压药。特殊人群高血压的治疗，脑血管病病人宜选用的药物是噻嗪类利尿药（C对）。噻嗪类利尿药可降低高血压并发症如脑卒中和心力衰竭的发病率和病死率。α-受体阻断剂（α-RB）（A错）适用于高血压伴前列腺增生患者。β-受体阻断剂（β-RB）（B错）适用于交感神经活性增高以及高动力状态的高血压患者，如伴有快速型心律失常、冠心病、慢性心力衰竭的患者。醛固酮受体拮抗剂（D错）可用于难治性高血压。血管紧张素转换酶抑制剂（ACEI）（E错）适用于伴慢性心力衰竭、心肌梗死后心功能不全、心房颤动、糖尿病肾病、慢性肾脏病、代谢综合征、蛋白尿或微量白蛋白尿的患者。